患儿，2岁。泄泻2天，大便日行10余次，质稀如水，色黄混浊。精神不振，口渴心烦，眼眶凹陷，皮肤干燥，小便短赤，舌红少津，苔少。其治法是
A. 消食化积
B. 疏风散寒
C. 酸甘敛阴
D. 渗湿止泻
E. 清热利湿

正确答案：C。酸甘敛阴

解析：患儿症见泄泻2天，质稀如水，色黄混浊，诊断为泄泻。又见精神不振，口渴心烦，眼眶凹陷，皮肤干燥，小便短赤。舌红少津，苔少，表明患儿阴津耗伤。此为泄泻之变证--气阴两伤，治疗时除止泻外应及时敛阴生津（C对）。消食化积用于伤食泻（A错）。疏风散寒用于风寒泻（B错）。渗湿止泻用于脾虚泻（D错）。清热利湿用于湿热泻（E错）。